治疗头痛肝阳上亢证，应首选
A. 风池、太冲、合谷、内关、后溪
B. 风池、百会、悬颅、侠溪、行间
C. 上星、头维、合谷、阿是穴
D. 百会、通天、行间、阿是穴
E. 率谷、太阳、侠溪、内庭

正确答案：B。风池、百会、悬颅、侠溪、行间

解析：头痛肝阳上亢证属于内伤头痛，其足厥阴经脉会于巅，足少阳经脉布于头之两侧，取两经之病部与循经远取相配以平熄亢逆之风阳（B对）。合谷可用于阳明（前额）头痛，后溪可用于太阳头痛，内关可治瘀血头痛（A错）。此组搭配少了平肝潜阳的穴位，可用于风邪袭络的前头痛（C错）。百会、通天、行间、阿是穴可用于风邪袭络之厥阴头痛（颠顶痛）（D错）。率谷、太阳、侠溪可用于风邪袭络之侧头部痛（E错）。